20岁。男性，夜间骑自行车，头朝下跌于壕沟，发现四肢不全瘫，X线片显示齿状突骨折伴半脱位，此时在治疗上最先采取的措施是
A. 石膏固定
B. 颅骨牵引固定
C. 吊带牵引
D. 环枕固定术
E. 切开复位内固定

正确答案：B。颅骨牵引固定

解析：患者头颈外伤后，四肢不全瘫（提示有脊髓损伤），X线片显示齿状突骨折伴半脱位，结合患者病史、临床表现和影像学检查，该患者最可能的诊断为齿状突骨折半脱位，可能合并脊髓损伤，此时在治疗上最先采取的措施是颅骨牵引固定（牵引有复位的功能）（B对），防止骨折端移位加重脊髓的损伤。石膏领固定（A错）、环枕固定术（D错）均属于骨折的固定治疗，需在复位的基础上实施，故不是该患者最先采取的措施。吊带牵引（C错）多用于颈椎的半脱位治疗。切开复位内固定（E错）多用于骨折伴明显移位者。